8个月男孩，持续高热，频咳，精神萎靡5天，近2天气促加重，今抽搐3次，全身性发作，嗜睡。查体：体温40.0℃，呼吸56次/分，心率148次/分，双肺少量中细湿啰音，左下肺可闻管状呼吸音，白细胞计数4.0×10⁹/L，腰椎穿刺颅压稍高，脑脊液常规正常。惊厥的原因是
A. 心力衰竭
B. 高热惊厥
C. 败血症
D. 中毒性脑病
E. 癫痫

正确答案：D。中毒性脑病

解析：根据该患儿的临床表现持续高热，频咳，精神萎靡，抽搐，全身性发作，嗜睡，和体征：高热40.0℃，呼吸气促56次/分，心率加快148次/分，双肺少量中细湿罗音，左下肺可闻管状呼吸音，白细胞计数4.0×10⁹/L，腰椎穿刺颅压稍高，即可判定为腺病毒肺炎；急性细菌性感染为中毒性脑病的主要病因，其次由流感病毒、副流感病毒、合胞病毒、腺病毒引起的急性呼吸道感染和疟疾亦可引起中毒性脑病（D对）。